女性，30岁。被汽车撞伤左季肋部1小时来诊。查体体温37.5度，脉搏110次/分，血压90/60mmHg。腹平坦，左上腹肌略紧张，局部压痛，全腹有反跳痛，有移动性浊音（+），听诊未闻肠鸣音。首选的检查是
A. 平卧位X线腹部平片
B. 胸部X线检查
C. 腹部CT
D. 上消化道钡餐透视
E. 诊断性腹腔穿刺

正确答案：E。诊断性腹腔穿刺

解析：青年女性患者，左上腹外伤史（提示脾脏损伤），腹膜刺激征轻微，腹部移动性浊音阳性，肠鸣音消失（提示腹腔内出血），结合患者病史、症状和体征，应考虑为脾破裂。为明确诊断，应首选诊断性腹腔穿刺（E对）。诊断性腹腔穿刺可以明确出血的来源，对判断哪种类型的脏器损伤有重要价值。平卧位X线腹部平片（A错）对腹部空腔脏器破裂具有一定的诊断价值；胸部X线检查（B错）可以明确有无肋骨骨折和气胸等损伤；上消化道钡餐透视（D错）主要用于消化道溃疡、胃肠肿瘤等疾病的诊断，上述检查均不能确诊脾破裂。腹部CT（C错）可以明确脏器损伤的类型及其损伤的程度、范围，但由于操作较复杂，价格昂贵，一般不作为首选。